临床中一般不用作浸润麻醉的药物是
A. 利多卡因
B. 普鲁卡因
C. 丁卡因
D. 阿替卡因
E. 奴氟卡因

正确答案：C。丁卡因

解析：丁卡因又名地卡因，穿透力强。临床上主要用作表面麻醉。麻醉作用较普鲁卡因强10倍。由于毒性大，一般不作浸润麻醉，即使用作表面麻醉，亦应注意剂量。掌握“颌面部常用局麻法及牙拔除的麻醉选择”知识点。